上述病原体中，最常见于社区获得性肺炎的是
A. 肺炎克雷伯杆菌
B. 大肠埃希菌
C. 铜绿假单胞菌
D. 金黄色葡萄球菌
E. 流感嗜血杆菌

正确答案：E。流感嗜血杆菌

解析：社区获得性肺炎（CAP）是指在医院外罹患的感染性肺实质炎症，包括具有明确潜伏期的病原体感染而在入院后平均潜伏期内发病的肺炎。CAP的病原体有肺炎链球菌、支原体、衣原体、流感嗜血杆菌、呼吸道病毒等，其中最常见的为肺炎链球菌，但根据选项，本题选择流感嗜血杆菌（E对）。肺炎克雷伯杆菌（A错）、大肠埃希菌（B错）、铜绿假单胞菌（C错）、金黄色葡萄球菌（D错）是引起医院获得性肺炎的常见致病菌。